听诊表现为连续性杂音的是
A. 主动脉瓣狭窄
B. 动脉导管未闭
C. 肺动脉狭窄
D. 二尖瓣狭窄
E. 室间隔缺损

正确答案：B。动脉导管未闭

解析：动脉导管未闭，存在连续性主动脉至肺动脉分流，因此听诊表现为连续性杂音（B对）。主动脉瓣狭窄（A错）为胸骨右缘1～2肋间粗糙而响亮的收缩期射流性杂音。肺动脉瓣狭窄（P275）C错）的典型杂音为胸骨左缘第二肋间的收缩期杂音。二尖瓣狭窄（P287）（D错）为心尖区舒张中晚期低调的隆隆样杂音。室间隔缺损（P273）（E错）为胸骨左缘第3～4肋间Ⅳ～Ⅵ级全收缩期杂音。